部分病人首次用药后可出现直立性低血压、眩晕、出汗、心悸等反应的药物是
A. 普萘洛尔
B. 哌唑嗪
C. 甲基多巴
D. 氨氯地平
E. 尼群地平

正确答案：B。哌唑嗪

解析：本题考查哌唑嗪的不良反应。部分病人首次用药后可出现直立性低血压、眩晕、出汗、心悸等反应的药物是哌唑嗪（B对）。哌唑嗪首次给药可致严重的体位性低血压、晕厥、心悸等，称“首剂现象”，多见于首次用药90分钟内，发生率高达50%。普萘洛尔（A错）为非选择性的β受体阻断剂，常见不良发应有诱发支气管哮喘、外周血管收缩和痉挛、反跳现象等。甲基多巴（C错）为中枢降压药，不良反应有嗜睡、乏力、抑郁、眩晕、头痛、口干、直立性低血压。偶见帕金森综合征、关节痛和肌痛、心绞痛加剧、心动过缓、白细胞减少、血小板减少和黄疸等。氨氯地平（D错）、尼群地平（E错）为钙通道阻滞剂，不良反应为心功能不全、低血压、面部潮红、下肢及踝部水肿等。